适用于伴有心衰或支气管哮喘的抗心绞痛药物是
A. 硝酸异山梨酯
B. 哌唑嗪
C. 哌克昔林
D. 普尼拉明
E. 普萘洛尔

正确答案：C。哌克昔林

解析：哌克昔林有钙拮抗、利尿、扩张支气管作用，适用于伴有心衰、支气管哮喘的心绞痛（C对）。硝酸异山梨酯为血管扩张药，临床可用于治疗各种类型冠心病心绞痛和预防发作（A错）。哌唑嗪治疗充血性心力衰竭及心肌梗死后心力衰竭（B错）。普尼拉明（心可定）不但阻滞钙内流，还有儿茶酚胺耗竭作用，适于各种心绞痛的治疗（D错）。普萘洛尔（心得安）用于对硝酸酯类效果较差的稳定型心绞痛患者，可减少发作次数，对并发有高血压和心律失常者尤其合适。因本药能导致冠状动脉收缩，不宜用于变异型心绞痛；因能引起支气管收缩，不能用于伴有支气管哮喘的心绞痛患者（E错）。